能够广泛应用于颌面部和上颈部术后和损伤的包扎和固定的绷带缠绕方法是
A. 三角带
B. 四头带
C. 交叉十字绷带
D. 颅颌弹性绷带
E. 面部绷带

正确答案：C。交叉十字绷带

解析：本题考查常用绷带类型及应用。能够广泛应用于颌面部和上颈部术后和损伤的包扎和固定的绷带缠绕方法是交叉十字绷带（C对）。三角带（A错），三角巾包扎，可用于手部、足部包扎，还可对脚挫伤进行包扎固定，对不便上绷带的伤口进行包扎和止血。四头带（B错）亦称四尾带，常用于包扎鼻部创口，包扎下颌、颏部创口，压迫术后创口。颅颌弹性绷带（D错）用于各种骨折及术后颌骨制动。面部绷带（E错）常用于上颌骨、面、颊部手术后的创口包扎。